下列表观遗传毒性致癌物中属于过氧化物酶体增殖剂的是
A. 佛波醇酯
B. 咪唑硫嘌呤
C. 三氯乙烯
D. 硫脲
E. 氯仿

正确答案：C。三氯乙烯